从病因学角度而言，龋病也属于牙体硬组织
A. 细菌腐蚀性疾病
B. 细菌感染性疾病
C. 显性基因遗传性疾病
D. 隐性基因遗传性疾病
E. 物理性损伤

正确答案：B。细菌感染性疾病

解析：本题考查龋病概述。从病因学角度而言，龋病也属于牙体硬组织的细菌感染性疾病（B对）。